下列关于结膜的说法何者正确
A. 为一层薄而不透明的黏膜
B. 位于角膜和巩膜的外面
C. 位于眼睑的后面和眼球的前面
D. 结膜囊不与外界相通
E. 以上均不正确

正确答案：C。位于眼睑的后面和眼球的前面

解析：结膜为一层薄而透明的黏膜，而非薄而不透明（A错），位于角膜的外面，而非角膜和巩膜的外面（B错），即位于眼睑的后面和眼球的前面（C对）。结膜囊经眼睑与外界相通，而非不与外界相通（D错）。